某大学实行戒烟活动，开展戒烟班，规定吸烟者不可领奖学金，不得参与学生会，问这种行为属于什么
A. 戒烟促进
B. 戒烟行为
C. 戒烟预防
D. 戒烟执行
E. 戒烟教育

正确答案：A。戒烟促进

解析：该活动可以有效促进学生戒烟，属于戒烟促进行为（A对）。